关于预防性树脂充填，描述正确的是
A. C型暴露的牙本质不需要垫底
B. C型仅用于流动树脂材料充填
C. A型不需要进行酸蚀
D. A型用不含填料的封闭剂充填
E. B型仅用复合树脂材料充填

正确答案：D。A型用不含填料的封闭剂充填

解析：本题考查预防性树脂充填。基于龋损范围、深度和使用的充填材料，可将预防性树脂充填分为以下三种类型：1.类型A：需用最小号球钻去除脱矿牙釉质，用不含填料的封闭剂充填（D对）。2.类型B 用小号或中号球钻去除龋损组织，洞底基本在牙釉质内，通常用流动树脂材料充填。B型用流动树脂材料或加有填料的封闭剂充填（E错），固化后在牙合面上涂布一层封闭剂。3.类型C 用中号或较大球钻去除龋损组织，洞底己达牙本质故需垫底（A错），涂布牙本质或牙釉质粘接剂后用复合树脂材料充填，其余窝沟做封闭（B错）。预防性树脂充填除了去除龋坏组织和使用粘接剂外，其操作步骤与窝沟封闭相同，均需要酸蚀牙牙合面及窝洞（C错）。